女，35岁，不规则阴道流血2个月。妇科检查发现阴道壁上有一紫红色结节。病理检查见大量血块及坏死组织中散在一些异型的滋养层细胞团，无绒毛结构。应诊断为
A. 侵蚀性葡萄胎
B. 子宫颈癌
C. 绒毛膜癌
D. 子宫内膜癌
E. 水泡状胎块

正确答案：C。绒毛膜癌

解析：患者为育龄期妇女，持续的阴道不规则流血，妇科检查发现阴道壁上有一紫红色结节（阴道转移时，转移灶常位于阴道前壁及穹窿，呈紫蓝色结节）。病理检查见大量血块及坏死组织中散在一些异型的滋养层细胞团，无绒毛结构，应诊断为绒毛膜癌（C对BD错）。侵蚀性葡萄胎镜下可见绒毛结构（A错）。水泡状胎块（P336）（E错）又称葡萄胎，为良性病变，不会发生阴道转移葡萄胎残留。